下列不属于内脏运动神经特点的是
A. 内脏运动神经又称植物性神经
B. 一般不受意识支配
C. 自低级中枢发出至所支配的器官要换一次神经元
D. 有交感和副交感两种纤维成分
E. 低级中枢位于脊髓内

正确答案：E。低级中枢位于脊髓内

解析：内脏运动神经调节内脏、心血管等器官的运动及腺体的分泌，通常不受人的意志控制（B对），是不随意的，故又称自主神经系统;又因它主要是控制和调节动、植物共有的物质代谢活动，并不支配动物所特有的骨骼肌的运动，所以也称植物神经系统（A对）。内脏运动神经自低级中枢发出后必须在周围部的内脏运动神经节（植物性神经节）交换神经元，由节内神经元再发出纤维到达效应器（C对）。内脏运动神经有交感和副交感两种纤维成分（D对）。低级中枢位于脊髓Tl-L3节段的灰质侧柱的中间外侧核以及脑干的一般内脏运动核和脊髓骶部第2-4节段灰质的骶副交感核（E错，为本题正确选项）。